既可以产生假设又可以检验假设的研究为
A. 现况研究
B. 病例对照研究
C. 队列研究
D. 实验流行病学
E. 理论流行病学

正确答案：B。病例对照研究

解析：本题考查病例对照研究的用途。病例对照研究（B对ACDE错）可以广泛探索病因或危险因素，也可在描述性研究或探索性病例对照研究初步形成病因假说的基础上检验某个或某几个病因假说。